肉豆蔻与白豆蔻均具有的功效是
A. 涩肠止泻，下气平喘
B. 温中散寒，行气消胀
C. 温中行气，燥湿止带
D. 收敛固涩，制酸止痛
E. 涩肠止泻，敛肺止咳

正确答案：B。温中散寒，行气消胀

解析：该题考查肉豆蔻与白豆蔻的功效。肉豆蔻味辛，性温；入中焦暖脾胃而散寒，能温中理脾，行气消胀；白豆蔻味辛，性温；能温胃散寒而止呕，行气宽中而消胀，二者共有温中散寒，行气消胀的功效（B对ACDE错）。